平滑面龋病损体部孔隙所占容积
A. 0.01
B. 0.05
C. 2～4%
D. 5%～25%
E. 10%～30%

正确答案：D。5%～25%

解析：病损体部：是釉质龋病变的主要部分，从表层下一直延伸到近暗层。将牙纵断磨片浸于树胶、喹啉观察，病损体部显示为较为透明，与暗层之间界限清楚。此层脱矿程度较为严重，约占釉质容积5%～25%。掌握“牙釉质龋”知识点。